药物过敏性口炎面积广泛，糜烂和渗出严重者，可给予激素，选用激素的方法为
A. 口服泼尼松，每日10～20mg
B. 口服泼尼松，每日20～30mg
C. 口服泼尼松，每日30～60mg
D. 口服泼尼松，每日60～70mg
E. 口服泼尼松，每日60～80mg

正确答案：C。口服泼尼松，每日30～60mg

解析：本题考查血管神经性水肿。 面积广泛，糜烂和渗出严重者，可给予激素。如口服泼尼松，每日30～60mg（C对）或地塞米松静脉滴注，待症状减轻后，改为口服维持。轻症者可给泼尼松每日15～30mg（AB错），顿服。